属于乙类传染病的疾病是
A. 麻疹
B. 麻风病
C. 流行性感冒
D. 急性出血性结膜炎
E. 风疹

正确答案：A。麻疹

解析：属于乙类传染病的是麻疹（A对）。麻风病（B错）、流行性感冒（C错）、急性出血性结膜炎（D错）、风疹（E错）属于丙类传染病。